羚羊角的主治病证是
A. 阳亢眩晕，心悸失眠
B. 阳亢眩晕，目赤目昏
C. 阳亢眩晕，吐血衄血
D. 阳亢眩晕，湿疹湿疮
E. 阳亢眩晕，肝热急惊

正确答案：E。阳亢眩晕，肝热急惊

解析：本题考查的是平肝息风药羚羊角的主治病证。羚羊角的主治病证是阳亢眩晕，肝热急惊（E对）。羚羊角：【主治病证】（1）肝热急惊，癫痫抽搐。（2）肝阳上亢之头晕目眩。（3）肝火炽盛之目赤头痛。（4）温热病之壮热神昏、谵语狂躁或抽搐，温毒发斑，疮痈肿毒。牡蛎：【主治病证】（1）阴虚阳亢之头晕目眩，阴虚动风。（2）烦躁不安，心悸失眠（A错）。（3）瘰疬痰核，癥瘕积聚。（4）自汗，盗汗，遗精，带下，崩漏。（5）胃痛泛酸。石决明：【主治病证】（1）肝阳上亢之头晕目眩。（2）肝火目赤翳障，肝虚目昏（B错）。赭石：【主治病证】（1）肝阳上亢之头晕目眩。（2）嗳气，呃逆，呕吐，喘息。（3）血热气逆之吐血、衄血（C错）、崩漏。珍珠母：【主治病证】（1）肝阳上亢之头晕目眩，惊悸失眠。（2）肝热目赤，肝虚目昏。（3）湿疹，湿疮（D错）。